语音震颤减弱见于
A. 肺炎
B. 肺梗死
C. 肺脓肿
D. 空洞性肺结核
E. 阻塞性肺不张

正确答案：E。阻塞性肺不张

解析：语音震颤操作方法是：病人发出声音，音波产生的震动，沿着气管、支气管及肺泡，传到胸壁引起共鸣的震动，检查者用手触知，感受震颤变化。语音震颤的强弱取决于气管、支气管是否通畅，胸壁传导是否良好。肺炎（A错）、肺梗死（B错）时，肺组织实变，传导良好，语颤增强。肺脓肿（C错）、空洞性肺结核（D错）时，肺内产生巨大空腔，声波在空腔产生共鸣，利于声波传导，语颤增强。阻塞性肺不张时一个或多个肺段或肺叶的含气量减少，不利于声音传导，语颤减弱（E对）。